女，33岁，产后无乳，闭经4年，昏迷一天。查体：体温35度，P90次/分，血压80/40mmHg，面色苍白，腋毛阴毛缺失。血K⁺4.5mmol/L，Na⁺126.4mmol/L，血糖3.1mmol/L，该患者的治疗为
A. 降血压药
B. 高渗葡萄糖
C. 高渗盐水
D. 糖皮质激素
E. 甲状腺素

正确答案：B。高渗葡萄糖

解析：患者产后（此为腺垂体功能减退症的病因之一）出现无乳、闭经、阴毛、腋毛缺失（性腺功能减退表现），低钠、低血压（肾上腺功能减退表现），宽松苍白（ACTH缺乏），考虑腺垂体功能减退。查体：T35℃，BP80/40mmHg，血糖3.1mmol/L，昏迷（垂体危象的表现）。结合患者的病史、症状、体征，考虑垂体危象，其治疗首先给予静脉推注50%葡萄糖液40～80ml抢救低血糖，继而补充5%葡萄糖盐水滴注，以解除急性肾上腺功能减退危象（B对）及抢救低血糖症及失水等。患者血压80/40mmHg，降血压药（A错）会加重血压降低。高渗盐水（C错）、糖皮质激素（D错）也是垂体危象时的处理，但不是立即处理的。目前不能确定是否存在甲状腺功能减退，暂不需要补充甲状腺素（E错）。